小剂量抑制血小板中的COX-1，防止血栓形成的药物是
A. 对乙酰氨基酚
B. 吡罗昔康
C. 美洛昔康
D. 双氯芬酸
E. 阿司匹林

正确答案：E。阿司匹林

解析：本题考查阿司匹林。阿司匹林（E对）是不可逆性COX（环氧酶）抑制剂，较低剂量时抑制COX-1，减少TXA₂产生，抑制TXA₂诱导的血小板聚集，防止血栓形成。对乙酰氨基酚（A错）为解热镇痛药，通过抑制COX，减少炎症介质的产生。吡罗昔康（B错）和美洛昔康（C错）均为非甾体抗炎药，可用于炎症和退行性风湿病。双氯芬酸（D错）是一种非甾体抗炎药,具有抗炎、镇痛及解热等作用。